CTL代表的细胞是
A. B淋巴细胞
B. CD8⁺T细胞
C. 巨噬细胞
D. 肥大细胞
E. CD4⁺T细胞

正确答案：B。CD8⁺T细胞